下列化学物质毒性大小比较正确的顺序是
A. 戊烷﹥已烷﹥庚烷
B. CH₄﹥CH₃Cl﹥CH₂Cl₂﹥CHCl₃﹥CCl₄
C. 苯酚﹤苯
D. 伯胺﹤仲胺﹤叔胺
E. 乙炔﹥乙烯﹥乙烷

正确答案：E。乙炔﹥乙烯﹥乙烷